在WHO定义的三组疾病中，属于第二组疾病的是
A. 伤害
B. 传染病
C. 慢性病
D. 孕产期疾病
E. 营养不良性疾病

正确答案：C。慢性病

解析：本题考查WHO定义的三组疾病。在WHO定义的三组疾病中，第一组疾病是传染病（B错），孕产期疾病（D错）和营养不良性疾病（E错），第二组疾病是慢性病（C对），第三组疾病是伤害（A错）。